毛果芸香碱滴眼可引起
A. 缩瞳，升高眼内压，调节痉挛
B. 缩瞳，降低眼内压，调节麻痹
C. 扩瞳，降低眼内压，调节麻痹
D. 扩瞳，升高眼内压，调节痉挛
E. 缩瞳，降低眼内压，调节痉挛

正确答案：E。缩瞳，降低眼内压，调节痉挛

解析：调节痉挛：毛果芸香碱滴眼后，环状肌向瞳孔中心方向收缩，造成悬韧带放松，晶状体由于本身弹性变凸，屈光度增加，此时只适合于视近物，而难以看清远物，毛果芸香碱的这种作用称为调节痉挛。掌握“毛果芸香碱”知识点。